ABO血型抗原是
A. 异种抗原
B. 同种异型抗原
C. 异嗜性抗原
D. 自身抗原
E. 肿瘤相关抗原

正确答案：B。同种异型抗原